乳牙的创伤引起继承恒牙釉质形成不全的疾病为
A. 氟斑牙
B. 四环素牙
C. 特纳牙
D. 遗传性乳光牙本质
E. 哈钦森牙

正确答案：C。特纳牙

解析：特纳牙是指与乳牙有关的感染或创伤引起的继生恒牙成釉细胞的损伤，导致继生恒牙釉质的形成不全或矿化不全。掌握“四环素牙”知识点。